有关Ⅲ度胎盘早剥的说法，错误的是
A. 剧烈腹痛后，阴道流血
B. 阴道出血量与全身症状不成正比
C. 子宫底升高
D. 子宫板状
E. 无痛性阴道流血

正确答案：E。无痛性阴道流血

解析：Ⅱ度胎盘早剥常有突然发生的持续性腹痛、腰酸或腰背痛，疼痛的程度与胎盘后积血多少成正比，腹部检查见子宫大于妊娠周数，宫底随胎盘后血肿增大而升高，贫血程度与阴道流血量不相符。Ⅲ度临床表现较Ⅱ度加重，故Ⅲ度持续性腹痛、腰酸或腰背痛（E错，为本题正确答案）更明显，剧烈腹痛后阴道流血（A对）、宫底随胎盘后血肿增大而升高（C对）也更明显，可出现恶心、呕吐、面色苍白、四肢湿冷、脉搏细数、血压下降等休克症状，且休克程度大多与母血丢失成比例，但胎盘早剥的出血很有可能积聚在胎盘和子宫壁之间，不经阴道流出，阴道出血量与全身症状不成正比（B对）。腹部检查见子宫硬如板状（D对），宫缩间歇时不能松弛，胎位扪不清，胎心消失。